主要存在于熊胆中的是
A. 精氨酸
B. 强心甾烯
C. 麝香酮
D. 蟾蜍甾二烯
E. 鹅去氧胆酸

正确答案：E。鹅去氧胆酸